男，56岁。右腹股沟包块5年，伴胀痛，平卧位包块不能完全回纳，同时有便秘、“消化不良”。包块部位听诊可闻及肠鸣音，手术治疗时，应特别注意不要误伤
A. 腹壁下动脉
B. 精索内动脉
C. 盲肠或乙状结肠
D. 精索内静脉
E. 髂腹下神经和髂腹股沟神经

正确答案：C。盲肠或乙状结肠

解析：中年男性患者，右腹股沟包块、伴胀痛，包块部位听诊可闻及肠鸣音（可排除睾丸鞘膜积液，提示为腹股沟疝，疝内容物为肠管），平卧位包块不能完全回纳（提示为难复性腹股沟疝），同时有便秘、“消化不良”（滑动疝的表现），结合患者病史和临床表现，应诊断为右侧滑动疝。滑动疝临床上较少见，手术时易将滑入疝囊的盲肠或乙状结肠误认为是疝囊的一部分而被切开，因此，手术治疗时，应特别注意不要误伤盲肠或乙状结肠（C对）。腹壁下动脉（A错）、精索内动（B错）、静脉（D错）以及髂腹下神经和髂腹股沟神经（E错）等结构损伤为腹股沟疝的主要术后并发症，所有腹股沟疝手术治疗时，都应注意不要损伤上述结构。